12岁以下儿童，如患有感冒发热，可选用的药物有
A. 对乙酰氨基酚
B. 布洛芬
C. 尼美舒利
D. 塞来昔布
E. 氯丙嗪

正确答案：A、B。对乙酰氨基酚；布洛芬

解析：本题考查感冒药。12岁以下儿童，如患有感冒发热，可选用的药物有乙酰氨基酚（A对）和布洛芬（B对）。对乙酰氨基酚可作为退热药首选，尤其适用于老年人和儿童服用。布洛芬对胃肠道的不良反应较轻，易于耐受，为此类药物中胃肠刺激最低的。尼美舒利（C错）禁用于12岁以下儿童。塞来昔布（D错）用于急性期或慢性期骨关节炎和类风湿性关节炎的对症治疗。氯丙嗪（E错）为抗精神病药。